乳牙发育的时间
A. 胚胎第6周
B. 胎儿第2个月
C. 出生时
D. 出生后第6周
E. 出生后6个月

正确答案：B。胎儿第2个月

解析：本题考查牙的发育。乳牙发育的时间为胎儿第2个月（B对）。乳牙从胚胎第2个月开始发生，到3岁多牙根完全形成。以乳中切牙为例，从开始发生到牙根完全形成，约需要2年的时间。而恒牙胚的发育晚于乳牙胚，发育时间也更长，如恒中切牙则需10年左右的时间才能完成。